治痰湿阻肺咳喘宜用
A. 苏子降气丸
B. 蛤蚧定喘丸
C. 小青龙合剂
D. 镇咳宁糖浆
E. 桂龙咳喘宁胶囊

正确答案：E。桂龙咳喘宁胶囊

解析：本题考查的是桂龙咳喘宁胶囊的主治。治痰湿阻肺咳喘宜用桂龙咳喘宁胶囊（E对）。桂龙咳喘宁胶囊：【主治】外感风寒，痰湿内阻引起的咳嗽、气喘、痰涎壅盛；急、慢性支气管炎见上述证候者。苏子降气丸（A错）：【主治】上盛下虚、气逆痰壅所致的咳嗽喘息、胸膈满闷。蛤蚧定喘丸（B错）：【主治】肺肾两虚、阴虚肺热所致的虚劳欠咳、年老哮喘、气短烦热、胸满郁闷、自汗盗汗。小青龙合剂（C错）：【主治】风寒水饮，恶寒发热、无汗、喘咳痰稀。镇咳宁糖浆（D错）的主治，2022年考试指南未明确说明。